属于强腐蚀性的是
A. 高锰酸钾
B. 石油醚
C. 氯化钾
D. 氰化钾
E. 氢氧化钠

正确答案：E。氢氧化钠

解析：本题考查强腐蚀性物质。腐蚀性强的物质多为强酸、强碱、活泼非金属、活泼金属、强氧化剂等。氢氧化钠（E对）为强碱，腐蚀性强。